属于中医诊断基本原理的是
A. 见微知著
B. 四诊合参
C. 辨证论治
D. 整体观念
E. 天人合一

正确答案：A。见微知著

解析：中医诊断的基本原理有司外揣内、见微知著（A对）、以常衡变、因发知受。中医诊断的基本原则是整体审察、四诊合参（B错）、病证结合、动静合一。中医学理论体系的主要特点，一是整体观念（D错），二是辨证论治（C错）。